随着小儿年龄的增加
A. 脉搏增快，血压增高
B. 脉搏增快，血压减低
C. 脉搏减慢，血压增高
D. 脉搏减慢，血压减低
E. 脉搏、血压均无明显变化

正确答案：C。脉搏减慢，血压增高

解析：小儿随着年龄的增加在一定范围内脉搏逐渐减慢，血压逐渐增高（C对）（ABDE错）。